糖尿病患者，无酸中毒，血糖应控制在多少以内可考虑拔牙
A. 6.88mmol/L
B. 7.88mmol/L
C. 8.88mmol/L
D. 9.88mmol/L
E. 10.88mmol/L

正确答案：C。8.88mmol/L

解析：未得到控制的糖尿病是拔牙术的禁忌证，如需拔牙，血糖应在8.88mmol/L以内，且无酸中毒症状时才可进行。由于患者抗感染能力差，应在术前、术后给予抗生素。糖尿病患者接受胰岛素治疗者，拔牙术最好在早餐后1～2小时进行，术后还应注意进食情况，持续监测血糖变化。掌握“牙拔除的适应证与禁忌证”知识点。